神经细胞动作电位的幅度接近于
A. 钾平衡电位
B. 钠平衡电位
C. 静息电位绝对值与局部电位之和
D. 静息电位绝对值与钠平衡电位之差
E. 静息电位绝对值与钠平衡电位之和

正确答案：E。静息电位绝对值与钠平衡电位之和

解析：神经细胞动作电位的幅度接近于静息电位绝对值与钠平衡电位之和（E对）。神经细胞在接受到阈刺激或阈上刺激时，细胞膜上电压门控Na⁺通道大量被激活，造成Na⁺离子大量内流，动作电位去极化，直至达到了Na⁺的平衡电位水平这个过程才停止，形成了动作电位的上升支。静息电位是负值，钠平衡电位是正值，故神经细胞动作电位的幅度接近于静息电位绝对值与钠平衡电位之和（E对）。钾平衡电位（A错）接近于静息电位。